临床试验中对照采用临床上公认的、效果肯定的标准疗法，此种对照属于
A. 空白对照
B. 安慰剂对照
C. 标准对照
D. 自身对照
E. 历史对照

正确答案：C。标准对照

解析：本题考查标准疗法对照的概念。标准疗法对照（C对ABDE错）又叫做有效对照，是临床试验中最常用的一种对照方式，是以常规或现行的最好疗法（药物或手术）作对照。适用于已知有肯定疗效的治疗方法的疾病。